常用的表示一组同质观察值的平均水平的指标包括，除了
A. 几何均数
B. 百分位数
C. 中位数
D. 均数
E. 标准差

正确答案：E。标准差

解析：集中趋势指标是用于描述一组同质观察值的平均水平或集中位置的指标。平均数是描述数值变量资料集中趋势的一类应用最广泛的指标体系。常用的平均数包括：算术均数、几何均数与中位数和百分位数。而标准差是反映一组观察值的离散程度。掌握“定量资料的统计描述和推断”知识点。